出现“钩状足＂畸形，最有可能是何神经损伤所致
A. 坐骨神经
B. 胫神经
C. 腓总神经
D. 足底内、外侧神经
E. 无

正确答案：B。胫神经

解析：胫神经（B对）受损主要表现为足不能拓屈，不能以足尖站立，内翻力减弱。同时出现足底皮肤感觉障碍。由于小腿后群肌功能障碍，收缩无力，结果导致小腿前外侧群肌的过度牵拉，使足呈背屈和外翻位，出现所谓‘钩状足’畸形。腓总神经（C错）受伤后由于小腿前、外侧群肌功能丧失，表现为足不能背屈，趾不能伸，足下垂且内翻，呈“马蹄内翻足＂畸形,行走时呈＂跨阙步态＂。